可致驾驶员排尿增多、视力改变的是
A. 东莨菪碱
B. 氯苯那敏
C. 阿米洛利
D. 阿司匹林
E. 亚叶酸钙

正确答案：C。阿米洛利

解析：本题考查驾驶员用药。可致驾驶员排尿增多、视力改变的是阿米洛利（C对）。利尿剂阿米洛利及复方制剂服后尿液排出过多，出现口渴、头晕、视力改变。东莨菪碱（A错）可致驾驶员瞳孔变大、视物不清。氯苯那敏（B错）为抗组胺药，可引起眩晕、头痛、倦怠、嗜睡、乏力等反应。